听觉皮质的血液供应来自
A. 大脑前动脉
B. 大脑中动脉
C. 大脑后动脉
D. 前交通动脉
E. 基底动脉

正确答案：B。大脑中动脉

解析：听觉皮质为位于颞横回的大脑皮质，其血液供应来自大脑中动脉（B对）。